对频繁发作的短暂性脑缺血发作，应该应用的治疗是
A. 华法林
B. 阿司匹林
C. 噻氯匹啶
D. 噻氯匹啶加双嘧达莫
E. 尼莫地平

正确答案：A。华法林

解析：华法林属于抗凝药，主要用于心源性栓塞性短暂性脑缺血发作（TIA），还用于频繁发作（A对）的TIA或椎-基底动脉系统TIA，及对抗血小板治疗无效的病例。阿司匹林（B错）非噻氯匹啶（C错）和双嘧达莫（D错）属于抗血小板药，主要用于非心源性栓塞性TIA的治疗，也可用于TIA或小卒中发病一个月内的卒中风险较高的患者。尼莫地平（E错）为钙离子拮抗剂，用于高血压治疗。